肝肠循环是
A. 弱酸性或弱碱性药物解离常数
B. 弱酸性或弱碱性药物解离常数的负对数
C. 口服药物吸收时首次通过肝脏经转化而使进入体循环的药量减少
D. 收入血的药量
E. 药物随胆汁排泄到达小肠后被重新吸收的过程

正确答案：E。药物随胆汁排泄到达小肠后被重新吸收的过程

解析：肝肠循环是指由胆汁排入十二指肠的药物可从粪便排出体外，但也有的药物再经肠黏膜上皮细胞重吸收，经门静脉、肝脏重新进体循环的反复循环过程（E对）。